根据中药饮片所含化学成分或炮制方法的不同，确定不同的贮藏方法。关于中药饮片贮藏的说法，错误的是
A. 山药、葛根含淀粉多应贮藏于通风、干燥处以防虫蛀
B. 种子类饮片因炒制后增加了香气易受虫害应密闭贮藏
C. 动物类饮片易生虫和泛油并有腥臭气应密封保存
D. 薄荷、当归含挥发油多应置于25℃以下阴凉、干燥处贮藏
E. 盐炙饮片易吸湿而受潮温度过高盐分会析出应贮藏于密闭容器置通风干燥处

正确答案：D。薄荷、当归含挥发油多应置于25℃以下阴凉、干燥处贮藏

解析：本题考查的是中药饮片的贮藏要求。含挥发油多的药材和饮片，如薄荷、当归、川芎、荆芥等，应置阴凉、干燥处贮存（D错，为本题正确答案）。对于含不同性质化学成分或用不同炮制方法炮制的饮片，可根据其具体情况，确定不同的贮存方法。例如：1.含淀粉多的药材和饮片，如天麻、山药、粉葛根、葛根等，应贮于通风、干燥处，以防虫蛀（A对）。2.含挥发油多的药材和饮片，如薄荷、当归、川芎、荆芥等，贮藏时室温不可太高，否则容易走失香气或泛油，应置阴凉、干燥处贮存。3.含糖分及黏液质较多的饮片，如肉苁蓉、熟地黄、天冬、党参等，应贮于通风干燥处。4.种子类药材因炒制后增加了香气，如紫苏子、莱菔子、薏苡仁、扁豆等，若包装不坚固则易受虫害及鼠咬，故应密闭贮藏于缸、罐中（B对）。5.动物类药材主要有皮、骨、甲、蛇虫躯体，易生虫和泛油，并且有腥臭气味。应密封保存（C对），四周无鼠洞，并有通风设备，阴凉贮存。6.加酒炮制的当归、常山、大黄等饮片，加醋炮制的芫花、大戟、香附、甘遂等饮片，均应贮于密闭容器中，置阴凉处贮存。7.盐炙的泽泻、知母、车前子、巴戟天等饮片，很容易吸收空气中的湿气而受潮，若温度过高盐分就会从表面析出，故应贮于密闭容器内，置通风干燥处贮存（E对）。8.蜜炙的款冬花、甘草、枇杷叶等饮片，易被污染、虫蛀、霉变或鼠咬，通常密闭贮于缸、罐内，并置通风、干燥处贮存，以免吸潮。9.某些矿物类饮片如硼砂、芒硝等，在干燥空气中容易失去结晶水而风化，故应贮于密封的缸、罐中，并置于凉爽处贮存。10.少数贵重饮片如人参、西洋参、麝香、熊胆、西红花、冬虫夏草等，应与一般饮片分开贮藏，专人管理，并注意防虫、防霉，置阴凉、通风、干燥处贮藏。细贵药品中的麝香，应用瓶装密闭，以防香气走失；牛黄宜瓶装，在霉季时放入石灰缸中，以防受潮霉变；人参极易受潮、发霉、虫蛀、泛油、变色，在霉季也应放入石灰箱内贮存等。11.毒性中药应严格按照有关的管理规定办理，设专人负责管理，切不可与一般饮片混贮，以免发生意外事故。12.易燃的硫黄、火硝等，必须按照消防管理要求，贮存在安全地点。在夏天，应防止自燃。引发自燃的原因主要是含油脂的药材，层层堆置重压，中央产生热量散不出，局部温度增高所致。防止药材自燃的方法主要是药材应干燥，空气要流通，堆垛层间不能太高。